可分解产生尿酸的物质是
A. 鸟嘌呤
B. β-丙氨酸
C. 乳清酸
D. 阿糖胞苷
E. 胞嘧啶

正确答案：A。鸟嘌呤

解析：鸟嘌呤（A对）的分解代谢终产物是尿酸。